超声心动图检查评价心脏收缩功能的主要指标是
A. E/A
B. 左房大小
C. 左室大小
D. 右室大小
E. 左室射血分数

正确答案：E。左室射血分数

解析：超声心动图检查评价心脏收缩功能的主要指标是左室射血分数（LVEF）（E对）。E/A（A错）是反映心室舒张功能的指标，正常时应为＞1。左房大小（B错）、左室大小（C错）、右室大小（D错）均不是评价心脏收缩功能的主要指标。